根据下列血气分析结果，判断酸碱失衡的类型:PH:7.40，PaCO₂：67mmHg，HCO₃⁻：40mmol/L
A. 代谢性酸中毒合并呼吸性酸中毒
B. 代谢性酸中毒合并呼吸性碱中毒
C. 呼吸性酸中毒合并代谢性碱中毒
D. 呼吸性碱中毒合并代谢性碱中毒
E. 代谢性酸中毒合并代谢性碱中毒

正确答案：C。呼吸性酸中毒合并代谢性碱中毒

解析：PH为7.40在正常范围内，且患者PaCO₂（正常范围为33~46 mmHg），HCO₃⁻（正常为22~27 mmoI/L）均上升，两者变化方向相同，说明患者同时存在程度相近的混合型酸、碱中毒，PaCO₂增高，故可判断为呼吸性酸中毒；HCO₃⁻增高，可判断为代谢性碱中毒，故最终可判断为呼吸性酸中毒合并代谢性碱中毒（C对）。